注射破伤风抗毒素（TAT）的目的是
A. 对易感人群进行预防接种
B. 对可疑或确诊的破伤风患者进行紧急预防或治疗
C. 杀灭伤口中繁殖的破伤风梭（杆）菌
D. 主要用于儿童的预防接种
E. 中和与神经细胞结合的毒素

正确答案：B。对可疑或确诊的破伤风患者进行紧急预防或治疗

解析：破伤风病毒灭活后所制成的疫苗为破伤风类毒素。破伤风类毒素免疫马所得的的血浆经胃酶消化后纯化制成破伤风抗毒素（TAT）。类毒素为抗原，需要机体自身产生抗体，故开始发挥作用时间长，只作为对易感人群（A错）（包括儿童）（D错）的预防接种措施。而抗毒素为抗体，能迅速开始发挥作用。因此，可疑或确诊的破伤风患者应尽早皮下注射破伤风抗毒素（TAT）1500～3000U进行紧急预防或治疗（B对）。注射抗毒素的目的是中和游离的毒素，对已与神经细胞结合的毒素无效（E错）。杀灭伤口中繁殖的破伤风梭菌需要青霉素肌内注射（C错）。